某医师想评价超声筛查脂肪肝的价值，分别选择了经核磁共振氢谱检查法（HMRS）（金标准）诊断的95例脂肪肝患者和67例非患者进行超声检查，超声和金标准均为阳性的87例，均为阴性的为34例，该资料不可以计算的指标是
A. 灵敏度
B. 特异度
C. 预测值
D. 正确指数
E. 似然比

正确答案：C。预测值

解析：本题考查基于病例-非病例设计的筛查试验研究。在医院开展的，基于病例-非病例设计的筛查试验研究，病例组和非病例组的构成比不能代表目标人群的现患与未患比例，因此不能直接计算预测值（C对ABDE错）。